流浸膏剂的主要制法是
A. 浸渍法
B. 乳化法
C. 溶解法
D. 热熔法
E. 渗漉法

正确答案：E。渗漉法

解析：本题考查的是流浸膏剂的制备方法。流浸膏剂的主要制法是渗漉法（E对）。除另有规定外，流浸膏剂用渗漉法制备，也可用浸膏剂稀释而成。浸膏剂用煎煮法、回流法或渗漉法制备。全部提取液应低温浓缩至稠膏状，加稀释剂或继续浓缩至规定的量。浸渍法（A错）可用来制备酒剂。内服酒剂应以谷类酒为溶剂，可用浸渍法、渗漉法或其他适宜方法制备。热熔法（D错）为双黄连栓剂的制备方法。双黄连栓剂系指金银花、连翘、黄芩提取物，以半合成脂肪酸酯为基质，采用热熔法制备而成。制备方法为乳化法（B错）或溶解法（C错）的制剂，2022年考试指南未明确说明。